糖异生的关键酶不包括
A. 丙酮酸激酶
B. 磷酸烯醇式丙酮酸羧激酶
C. 丙酮酸羧化酶
D. 果糖二磷酸酶
E. 葡萄糖-6-磷酸酶

正确答案：A。丙酮酸激酶

解析：本题考查糖异生的关键酶。糖异生的关键酶不包括丙酮酸激酶（A错，为本题的正确答案）。糖异生的关键酶有四个，即丙酮酸羧化酶（C对）、磷酸烯醇式丙酮酸羧激酶（B对）、果糖二磷酸酶（D对）、葡萄糖-6-磷酸酶（E对），而丙酮酸激酶是糖酵解的关键酶。